腹腔干与肠系膜上动脉之间的联系主要通过
A. 胃右动脉
B. 胃十二指肠动脉
C. 胃短动脉
D. 右结肠动脉
E. 左结肠动脉

正确答案：B。胃十二指肠动脉

解析：胃十二指肠动脉（B对）为腹腔干与肠系膜上动脉之间的主要联系。其发出分支胃网膜右动脉和胰十二指肠动脉，分别与腹腔干及肠系膜上动脉的分支相联系。